不符合卫生资源分配的原则是
A. 效益最大化
B. 效率最大化原则
C. 公益化原则
D. 公正原则
E. 合理化原则

正确答案：B。效率最大化原则

解析：卫生资源配置是指政府或市场如何使卫生资源公平且有效率地在不同的领域、地区、部门、项目、人群中分配，从而实现卫生资源的社会和经济效益最大化，即合理公正地分配卫生资源，从而实现卫生资源的社会和经济效益最大化，因此，公正原则（D对）、合理化原则（E对）、效益最大化原则（A对）符合卫生资源配置原则。效率是指以尽可能少的投入获得尽可能多的产出，而卫生事业是政府实行一定福利政策的社会公益事业，因此，公益化原则也符合卫生资源配置原则（C对），效率最大化原则不符合卫生资源配置原则（B错，为本题正确答案）。